男，35岁。反复右腰部绞痛伴血尿。KUB见右肾结石，长径1.8cm。IVU见右肾轻度积水，输尿管显影正常。首选的治疗方法是
A. 经皮肾镜碎石取石
B. 输尿管镜碎石取石
C. 体外冲击波碎石
D. 药物排石
E. 抗炎治疗

正确答案：C。体外冲击波碎石

解析：患者反复右腰部绞痛伴血尿。KUB见右肾结石，长径1.8cm≤2cm，首选的治疗方法为体外冲击波碎（C对）。经皮肾镜碎石取石（A错）（P560）适用于所有需开放手术干预的肾结石，如≥2cm的肾结石和体外冲击波难以粉碎的结石。输尿管镜碎石取石（B错）（P561）适用于中、下段输尿管结石。药物排石（D错）（P560）主要用于结石＜0.6cm、结石表面光滑、结石以下尿路无梗阻的患者。抗炎治疗（E错）只能缓解肾绞痛，不能根治，不作为首选的治疗方法。